有的人得病，难以适应，有的人则“游刃有余”，很快渡过“难关”符合的观点为
A. 心身统一的观点
B. 认知评价的观点
C. 社会对个体影响的观点
D. 个性特征作用的观点
E. 情绪因素作用的观点

正确答案：D。个性特征作用的观点

解析：个性特征作用的观点：面对同样的社会应激，有的人得病，难以适应，有的人则“游刃有余”，很快渡过“难关”，这之中与个性特征有着十分密切的关系。个性的研究，使医学心理学更具特色。掌握“医学心理学概述、任务与观点”知识点。